幽门上、下淋巴结的输出管注入
A. 腹腔淋巴结
B. 肠系膜上淋巴结
C. 肠系膜下淋巴结
D. 腰淋巴结
E. 纵隔上淋巴结

正确答案：A。腹腔淋巴结

解析：腹腔淋巴结（A对）为幽门上、下淋巴结，胃左、右淋巴结，胃网膜左、右淋巴结，肝淋巴结，胰淋巴结和脾淋巴结的输出管注入部位。